去除中药中鞣质的方法有
A. 分馏法
B. 明胶法
C. 煎煮法
D. 升华法
E. 水蒸气蒸馏法

正确答案：B。明胶法

解析：本题考查的是除去鞣质的方法。去除中药中鞣质的方法有明胶法（B对）。除去鞣质的方法：1.冷热处理法；2.石灰法；3.铅盐法；4.明胶法；5.聚酰胺吸附法；6.溶剂法。明胶法是指在中药的水提取液中，加入适量4%明胶溶液，使鞣质沉淀完全，滤除沉淀，滤液减压浓缩至小体积，加入3～5倍量的乙醇，以沉淀过剩的明胶。分馏法（A错）是根据物质的沸点进行分离。通常利用中药中各成分沸点的差别进行分离。如挥发油和一些液体生物碱的提取分离常采用分馏法。煎煮法（C错）：是中药材加入水浸泡后加热煮沸，将有效成分提取出来的方法。此法简便，但含挥发性成分或有效成分遇热易分解的中药材不宜用此法。升华法（D错）：固体物质在受热时不经过熔融直接转化为气体状态，该气体遇冷后又凝结成固体的现象称为升华。中药中有一些成分具有升华的性质，能利用升华法直接从中药中提取出来。如樟木中的樟脑，茶叶中的咖啡因等。水蒸气蒸馏法（E错）：适用于具有挥发性的、能随水蒸气蒸馏而不被破坏，且难溶或不溶于水的化学成分的提取。此类化合物的沸点多在100℃以上，并在100℃左右有一定的蒸气压。